脾与志、液、体、华、窍的关系，说法正确的有
A. 在志为思
B. 在液为涎
C. 在体合肌肉，主四肢
D. 在窍为口，其华在唇
E. 在志为怒

正确答案：A、B、C、D。在志为思；在液为涎；在体合肌肉，主四肢；在窍为口，其华在唇

解析：本题考查的是脾与志、液、体、华、窍的关系。脾与志、液、体、华、窍的关系，说法正确的有在志为思（A对）、在液为涎（B对）、在体合肌肉，主四肢（C对）与在窍为口，其华在唇（D对）。脾与志、液、体、华、窍的关系：1.脾在志为思；2.脾在液为涎；3.脾在体合肌肉，主四肢；4.脾在窍为口，其华在唇。在志为怒（E错）的是肝。肝与志、液、体、华、窍的关系：1.肝在志为怒；2.肝在液为泪；3.肝在体合筋，其华在爪；4.肝在窍为目。